建筑工人不慎坠楼，腰剧痛，双下肢感觉运动障碍，大小便功能障碍。除手术外伤后早期最重要的治疗措施是
A. 抗生素
B. 止痛剂
C. 甘露醇与大剂量糖皮质激素
D. 防止褥疮
E. 留置尿管

正确答案：C。甘露醇与大剂量糖皮质激素

解析：患者坠楼后，腰剧痛，双下肢感觉运动障碍、大小便功能障碍（脊髓损伤表现），结合患者病史和临床表现，该患者最可能的诊断为脊柱骨折伴脊髓损伤。除手术外伤后早期最重要的治疗措施是甘露醇与大剂量糖皮质激素（C对）治疗，以降低脊髓组织水肿，减轻外伤后神经细胞的变性，预防脊髓缺血加重。抗生素（A错）、止痛剂（B错）、防止褥疮（D错）、留置尿管（E错）均为术后一般治疗方法，非早期最重要的治疗措施。